由交感缩血管神经神经末梢释放的主要神经递质是
A. 普萘洛尔
B. 去甲肾上腺素
C. 左旋多巴
D. 酚妥拉明
E. 肾上腺素

正确答案：B。去甲肾上腺素

解析：交感缩血管神经神经末梢释放的主要神经递质是去甲肾上腺素（B对），血管平滑肌主要有α和β2两类肾上腺素能受体，去甲肾上腺素与α受体结合可引起血管平滑肌收缩，而与β2受体结合则引起血管平滑肌舒张。